分析胎儿不同出生体重和围产儿死亡率之间是否有关，可以选用的统计方法是
A. t检验
B. F检验
C. χ²检验
D. 相关分析
E. 秩和检验

正确答案：D。相关分析

解析：分析胎儿不同的出生体重和围产儿死亡率之间是否有关，即研究两个变量之间的关系，常用的统计分析方法是相关分析（D对）。t检验（A错）的应用前提是两个样本分别来自方差相等的正态分布总体的假设成立。F检验（B错）通过计算假设检验的统计量F值，实现对总体均数是否有差别的推断。χ²检验（C错）主要目的是推断两个或多个总体率或构成比之间有无差别。秩和检验（E错）是一种非参数检验方法，当数据不满足参数检验的条件时使用的一种分析方法。